关于舌诊的临床意义描述欠妥当的是
A. 判断邪正盛衰
B. 区别病邪性质
C. 分析病位与病势
D. 估计病情预后
E. 预测康复时间

正确答案：E。预测康复时间

解析：舌诊的临床意义：分析病位浅深（C对）；区别病邪性质（B对）；判断邪正盛衰（A对）；分析病势进退（C对）；推测病情预后。可以根据望舌的结果，推测病情预后，病势发展向好还是向坏，但不能预测康复时间（E错，为本题正确答案）。